提出克隆选择学说的学者是
A. Ehrlich
B. Behring
C. Burnet
D. Landsteiner
E. 北里

正确答案：C。Burnet